下列各项不是常色表现的是
A. 面色红黄隐隐
B. 面色明润含蓄
C. 面色隐约微黄
D. 面色长夏稍黄
E. 面色潮红娇嫩

正确答案：E。面色潮红娇嫩

解析：我国正常人的常色特点是红黄隐隐，明润含蓄，不是潮红娇嫩（E错，为本题正确答案）。常色，是指人体健康时面部皮肤的色泽。我国正常人的常色特点是红黄隐隐，明润含蓄（AB对）。面色隐约微黄属于常色（C对）。常色又包含主色和客色两部分，因季节、气候、昼夜等外界因素变动而发生相应变化的肤色，称为客色，如长夏可面色稍黄也属于正常皮肤颜色（D对）。